患者，男，35岁。进食时左侧下颌下腺区肿胀、疼痛，停止进食数小时后，疼痛亦随之消退。检查见左侧导管口黏膜红肿，导管呈条索状，挤压腺体可见少许脓性分泌物自导管口溢出。如进行触诊检查，正确的触诊方法是
A. 从导管前部向后单手单指触诊
B. 从导管前部向后双手触诊
C. 从导管后部向前单手单指触诊
D. 从导管后部向前单手双指触诊
E. 从导管后部向前双手合诊

正确答案：E。从导管后部向前双手合诊

解析：下颌下腺及舌下腺的触诊则常用双手合诊法检查。涎腺导管的触诊除注意有无结石存在外，还应注意导管的粗细和质地。对有狭窄的涎腺导管的检查可采用探诊的方法，要选择钝、细的探针，且应在排除结石存在的可能时方能进行，以避免将结石推向深部。掌握“涎石病及下颌下腺炎”知识点。